对高血压危象者宜选用
A. β受体阻断剂和血管紧张素转换酶抑制剂
B. 血管紧张素转换酶抑制剂或血管紧张素Ⅱ受体阻断剂
C. 硝普钠或硝酸甘油
D. 利尿剂或醛固酮受体拮抗剂
E. α受体阻断剂或利尿剂

正确答案：C。硝普钠或硝酸甘油

解析：本题考查高血压危象。对高血压危象者宜选用硝普钠或硝酸甘油（C对）。高血压危象的治疗原则主要是需要快速平稳降压，减轻靶器官的损害，因此首选硝普钠、硝酸甘油、乌拉地尔等静脉降压药。β受体阻断剂和血管紧张素转换酶抑制剂（A错）用于高血压合并心力衰竭者。血管紧张素转换酶抑制剂或血管紧张素Ⅱ受体阻断剂（B错）适用于高血压合并糖尿病患者。利尿剂或醛固酮受体拮抗剂（D错）用于高血压合并脑血管病患者。α受体阻断剂（E错） 不作为一般高血压治疗的首选药，适用高血压伴前列腺增生患者。